下面关于艾滋病防治及其监督管理工作的表述，正确的是
A. 县级以上人民政府统一负责艾滋病防治及其监督管理工作
B. 县级以上卫生行政部门统一负责艾滋病防治及其监督管理工作
C. 县级以上疾病预防控制机构负责艾滋病防治及其监督管理工作
D. 县级以上人民政府有关部门按照职责分工负责艾滋病防治及其监督管理工作
E. 省级卫生行政部门按照职责分工负责艾滋病防治及其监督管理工作

正确答案：D。县级以上人民政府有关部门按照职责分工负责艾滋病防治及其监督管理工作